孕妇的合理膳食应该做到以下，但不包括
A. 供给充足的各种营养素
B. 合理烹调与加工
C. 食物选择多样化
D. 长期大量摄入高能量食物
E. 合理的膳食制度

正确答案：D。长期大量摄入高能量食物